有藏泄互用关系的两脏是
A. 心与肺
B. 肺与肾
C. 肾与肝
D. 肝与脾
E. 脾与心

正确答案：C。肾与肝

解析：肝与肾之间的关系可称为“肝肾同源”即“乙癸同源”，包括精血同源、藏泄互用（C对）以及阴阳互滋互制等方面。其中藏泄互用是指肝主疏泄，肾主封藏，二者之间存在着相互制约、相互为用的关系。疏泄与封藏相反相成，从而调节女子的排卵、月经来潮和男子的排精功能。若二者失调，女子可见月经失调，月经量多或闭经，以及排卵障碍；男子可见阳痿、遗精、滑精或阳强不泄等症。心与肺的关系主要体现为气与血的关系（A错）。肺与肾的关系，主要表现在呼吸运动、津液代谢及阴阳互资三个方面（B错）。肝与脾的关系，主要表现在疏泄与运化的相互为用、藏血与统血的相互协调关系（D错）。脾与心的关系，主要表现在血液生成与运行方面的相互为用、相互协同（E错）。